男，22岁。发热、咳嗽、胸痛3天入院，抗感染治疗一周后未见明显效果，仍咳嗽，胸痛加重，深呼吸时明显。查体：T37.5℃，右下肺呼吸音减弱，语颤减弱。胸片提示：右下肺大片状阴影，上缘呈弧形。为明确诊断，首选检查是
A. 支气管镜
B. 胸部CT
C. 痰找抗酸杆菌
D. 结核菌素试验
E. 胸腔穿刺

正确答案：E。胸腔穿刺

解析：患者为青年男性，发热、咳嗽、胸痛，抗感染治疗一周后未见明显效果，仍咳嗽，胸痛加重，深呼吸时明显，右下肺呼吸音减弱，语颤减弱，X线胸片提示：右下肺大片状阴影，上缘呈弧形，根据其临床表现和辅助检查，考虑诊断为胸腔积液，若要明确诊断，需明确积液性质，故首选的检查是胸腔穿刺（E对）（胸腔穿刺抽取积液，做胸水检查，可确定大多数积液的原因）。支气管镜（A错）主要用于观察气管和支气管的病变，无法抽取积液、明确积液性质。胸部CT（B错）为影像学检查，能显示少量的胸腔积液、肺内病变和转移性肿瘤，有助于病因的诊断，但不是首选的检查。痰找抗酸杆菌（C错）为确诊肺结核的检查方法。结核菌素试验（P66）（D错）广泛应用于检出结核杆菌的感染，对诊断儿童、少年和青年的结核病诊断有参考意义，该患者无结核病的临床表现，故不首选。